患者，女，45岁，因强直性脊柱炎住院，同时伴有胃溃疡、高血压及糖尿病，药师审核医嘱，发现应当禁用的药品是
A. 硝苯地平
B. 双氯芬酸
C. 雷尼替丁
D. 格列齐特
E. 二甲双胍

正确答案：B。双氯芬酸

解析：本题考查双氯芬酸。双氯芬酸（B对）属于芳基乙酸类非甾体抗炎药，对胃肠道有刺激性，可增加胃肠道出血的风险，故有胃肠道溃疡史者避免使用；硝苯地平（A错）为钙通道阻断药，可用于冠心病和高血压的治疗；雷尼替丁（C错）为组胺H₂受体阻断剂，用于治疗胃及十二指肠溃疡等；二甲双胍（E错）首选用于单纯饮食控制无效的2型糖尿病；格列齐特（D错）为磺酰脲类促胰岛素分泌药。